下列哪项不是楔状缺损的病因
A. 不正确的刷牙方法
B. 牙颈部釉质牙骨质界处结构薄弱
C. 微生物的作用
D. 酸的作用
E. 牙体组织疲劳

正确答案：C。微生物的作用

解析：本题考查楔状缺损的病因。微生物是龋病发生的主要因素（C错，为本题的正确答案）。楔状缺损的病因有：不正确的刷牙方法（A对）；牙颈部釉质牙骨质界处结构薄弱，甚至缺如（B对）；酸的作用（D对）；牙体组织疲劳（E对）。